男，38岁。3个月前搬重物后出现腰痛伴右下肢麻木疼痛，诊断为腰椎间盘突出症，经保守治疗后症状缓解，近期症状逐渐加重。2小时前出现大小便障碍，查体：T36.6℃，P89次/分，BP110/60mmHg，心肺腹未见异常，右下肢肌力4级，感觉减退，会阴部感觉减退，目前首选的治疗方法是
A. 理疗按摩
B. 激素注射
C. 牵引治疗
D. 急诊手术
E. 卧床休息

正确答案：D。急诊手术

解析：患者中青年男性，3个月前诊断为腰椎间盘突出症，经保守治疗后症状缓解，近期症状逐渐加重。于2小时前出现大小便障碍（括约肌功能障碍），BP110/60mmHg（正常值BP90～120/60～80mmHg），右下肢肌力4级，感觉减退，会阴部感觉减退（明显的神经受累表现）。根据患者的病史、临床表现、辅助检查可知腰椎间盘突出症加重，符合手术治疗适应症，应急诊手术（D对）。非手术治疗方法有卧床休息（E错），一般严格卧床休息3周，带腰围逐步下地活动；有用非甾体抗炎药；有激素注射（B错）；有牵引疗法（C错），骨盆牵引最常用；最后还有理疗（A错）。